关于急性根尖周炎应急处理操作注意点哪项是不正确的
A. 局部浸润麻醉要避开脓肿部位
B. 正确开髓并尽量减少钻磨震动
C. 用3％双氧水和次氯酸钠交替冲洗根管
D. 开髓后如果扩锉要开放引流3天
E. 如时间紧急，可在服用大量抗生素的情况下，一次性根管充填

正确答案：E。如时间紧急，可在服用大量抗生素的情况下，一次性根管充填

解析：本题考查急性根尖周炎的应急处理方法。急性根尖周炎的应急处理是在局麻下开通髓腔，穿通根尖孔，建立引流通道，使根尖渗出物及脓液通过根管得到引流，以缓解根尖部的压力，解除疼痛。应急处理时应注意：开髓后如果扩锉要开放引流3天（D对），待急性炎症消退后再进行常规治疗，不可行一次性根管充填（E错，为本题的正确答案），否则根尖渗出物及脓液得不到及时引流，会造成炎症局限转为慢性或使炎症扩散；局部浸润麻醉要避开脓肿部位（A对），否则将引起疼痛和感染扩散，麻醉效果差，以行阻滞麻醉为佳；正确开髓并尽量减少钻磨震动（B对），可用手或印模胶固定患牙减轻疼痛；初步清理扩大根管，用3％双氧水和次氯酸钠交替冲洗根管（C对），所产生的气泡可带走堵塞根管的分泌物。